根据《药品经营许可证》管理办法，下列正确的是
A. 《药品经营许可证》有效期满未换证的，由原发证机关注销
B. 《药品经营许可证》的正本应置于企业场所醒目位置
C. 药品经营暂停销售，由原发证机关收回
D. 药品经营暂停销售，由原发证机关注销
E. 药品经营企业终止经营药品或者关闭的，由原发证机关注销

正确答案：A、B、E。《药品经营许可证》有效期满未换证的，由原发证机关注销；《药品经营许可证》的正本应置于企业场所醒目位置；药品经营企业终止经营药品或者关闭的，由原发证机关注销

解析：本题考查的是药品经营许可证管理。根据《药品经营许可证》管理办法，下列正确的是《药品经营许可证》有效期满未换证的，由原发证机关注销（A对）；《药品经营许可证》的正本应置于企业场所醒目位置（B对）；药品经营企业终止经营药品或者关闭的，由原发证机关注销（E对）。药品经营许可证注销：根据《药品经营监督管理办法》的规定，药品经营企业有下列情形之一的，药品经营许可证由原发证机关注销，并予以公告：申请人主动申请注销药品经营许可证的；药品经营许可证有效期届满未申请换证的；药品经营企业终止经营药品的；药品经营许可证被依法撤销或吊销的；营业执照被依法吊销或注销的；法律、法规规定的应当注销行政许可的其他情形。药品零售企业企业及其人员的资质公示：企业应当在营业场所的显著位置悬挂药品经营许可证、营业执照、执业药师注册证等。营业人员应当佩戴有照片、姓名、岗位等内容的工作牌，执业药师和药学技术人员的工作牌还应当标明执业资格或者药学专业技术职称，在岗执业的执业药师应当挂牌明示。